明目蒺藜丸既能明目退翳，又能
A. 解郁清热
B. 清热养血
C. 清热解毒
D. 散风止血
E. 清热散风

正确答案：E。清热散风

解析：本题考查的是明目蒺藜丸的功能。明目蒺藜丸既能明目退翳，又能清热散风（E对）。明目蒺藜丸：【功能】清热散风，明目退翳。解郁安神颗粒：【功能】疏肝解郁，安神定志。解郁安神颗粒，既疏肝解郁，又安神定志，并兼清热（A错）、祛湿、化痰，情志不畅、肝气郁滞之心悸、烦躁、失眠较为适宜，兼热、兼痰湿者均可。加味逍遥丸：【功能】疏肝清热，健脾养血（B错）。鼻炎康片：【功能】清热解毒（C错），宣肺通窍，消肿止痛。荆芥：【功效】散风解表，透疹止痒，止血（D错）。